既泻下逐水，又去积杀虫的药是
A. 巴豆
B. 甘遂
C. 芫花
D. 红大戟
E. 牵牛子

正确答案：E。牵牛子

解析：本题考查的是牵牛子的功效。既泻下逐水，又去积杀虫的药是牵牛子（E对）。牵牛子：【功效】泻下，逐水，去积，杀虫。巴豆（A错）：【功效】泻下冷积，逐水退肿，祛痰利咽，蚀疮去腐。甘遂（B错）：【功效】泻水逐饮，消肿散结。芫花（C错）：【功效】泻水逐饮，祛痰止咳。外用杀虫疗疮。红大戟（D错）：【功效】泻水逐饮，消肿散结。